用华法林导致的高危出血倾向可选用
A. 右雷佐生
B. 奥美拉唑
C. 雷尼替丁
D. 维生素B₆
E. 维生素K₁

正确答案：E。维生素K₁

解析：本题考查药物的联合应用。华法林作为维生素K的拮抗剂可使凝血因子活化障碍，凝血时间延长。华法林导致高危出血倾向时可补充维生素K（E对）治疗。